下列哪项不是渗出液的特征
A. 穿刺液自凝
B. 呈现不同颜色或混浊
C. 比重>1.018
D. Rivalta试验（-）
E. 细胞数>500×10⁶/L

正确答案：D。Rivalta试验（-）

解析：渗出液多能自凝（A对），颜色不定，如红色血性积液见于恶性肿瘤、结核性胸膜炎、出血性疾病等；淡黄色脓液见于化脓性细菌感染；绿色见于铜绿假单胞菌感染；乳白色乳糜液由胸导管或淋巴管阻塞引起，含有大量细胞和细菌多浑浊（B对），比重>1.018（C对），细胞计数>500×10⁶/L（E对），可找到致病菌，黏蛋白定性阳性（D错，为本题正确答案）。漏出液多非炎症所致，色淡黄，呈浆液性，透明或微浑，比重<1.018，纤维蛋白原含量少不自凝，黏蛋白定量阴性，细胞计数常<100×10⁶/L。